患者年龄是21岁，PD4-6，经常出血，牙龈肿胀，龈缘有红边，经过牙周治疗一年来未见好转，最可能的诊断是
A. 线形红斑
B. 慢性龈炎
C. ANUG
D. 牙周炎

正确答案：A。线形红斑

解析：本题考查为与HIV有关的牙周病损。患者PD4-6，经常出血，牙龈肿胀，龈缘有红边，经过牙周治疗一年来未见好转，最可能的诊断是线形红斑（A对）。线形牙龈红斑(LGE)在龈缘处有明显的鲜红的宽约2-3mm的红边，在附着龈上可呈淤斑状，极易出血。